牙周治疗时，龈下刮治器刮除牙石工作端与牙面之间的角度是
A. 45°
B. 60°
C. 80°
D. 90°
E. 105°

正确答案：C。80°

解析：刮治器的工作面呈0°角进入袋底，即刮治器工作端进入牙周袋时工作面与根面平行，轻轻放入袋底处牙石的基底部。刮治时要改变刮治器的工作面与牙面的角度至45°～90°角之间，以70°～80°角为最佳，形成适当的“切割”位置，并以此角度进行刮治。掌握“慢性牙周炎的治疗原则、程序及方法”知识点。